男婴，6个月。足月顺产，人工喂养。查体：体重5.4kg，身长66cm，前囟未闭，未出牙，皮肤干燥，腹部皮下脂肪厚度0.6cm，心、肺未见异常。最可能的诊断是
A. 重度营养不良消瘦型
B. 中度营养不良
C. 轻度营养不良
D. 重度营养不良水肿型
E. 正常婴儿

正确答案：C。轻度营养不良

解析：按体重：Ⅰ度：体重低于正常均值15%～25%；Ⅱ度：体重低于正常均值25%～40%；Ⅲ度：体重低于正常均值40%～60%。腹部皮下脂肪是重要的分度标准：Ⅰ度营养不良皮下脂肪为0.4～0.8cm。Ⅱ度营养不良皮下脂肪为0.4cm以下。Ⅲ度营养不良皮下脂肪消失。该患儿体重为5.5kg（正常6月儿的体重为7.75kg左右），下降28%，另外有前囟未闭、未出牙、皮肤干燥、腹部皮下脂肪厚度减少得临床表现，应诊断为营养不良。腹部皮下脂肪是重要的分度标准：轻度营养不良皮下脂肪为0.4～0.8cm、中度营养不良皮下脂肪为0.4cm以下、重度营养不良皮下脂肪消失。由此可知，体重和皮下脂肪不一致时，按照体重计算该患儿是轻度营养不良（C对ABD错），脂肪和体重不一致，应该按照皮下脂肪来算。该患儿已有体重下降、腹部皮下脂肪减少得表现，不可能是正常儿（E错）。